下列哪种情况不适用于病例对照研究
A. 探索病因和检验病因假设
B. 研究药物副作用
C. 简述“三间分布”
D. 研究影响疾病预后的因素

正确答案：C。简述“三间分布”

解析：本题考查病例对照研究的适用条件。病例对照研究适用于：①探索病因和检验病因假设（A对）；②研究药物副作用（B对）；③研究影响疾病预后的因素（D对）。描述性研究可以描述疾病的三间分布（C错，为本题正确答案），病例对照研究属于分析性研究，无法获得疾病三间分布资料。